患者患系统性红斑狼疮，刻下症见：神疲乏力，自汗，脱发，心悸气短，形寒肢冷，腰膝酸痛，身肿腹胀，食欲不振，恶心呕吐，舌淡胖苔薄白，脉沉细。其证型是
A. 肝虚血瘀
B. 阴虚内热
C. 脾虚痰浊
D. 脾肾阳虚
E. 肾阳虚衰

正确答案：D。脾肾阳虚

解析：患者患系统性红斑狼疮，本证多由肝肾阴虚或气阴两虚发展而来，由于阴损及阳，脾肾阳虚，故见面黄、形寒、神萎；肾不主水，脾不制水，阳虚水泛，故见全身浮肿，严重者可致胸水、腹水；水气凌心犯肺，故见喘咳痰鸣，心悸气促，最终发展至尿闭无尿。腹胀，纳少，腰膝酸软，舌胖质淡，脉沉，均为脾肾阳虚之征（D对）。